化脓性颌骨骨髓炎约占各类型颌骨骨髓炎的比例是
A. 50%以上
B. 60%以上
C. 70%以上
D. 80%以上
E. 90%以上

正确答案：E。90%以上

解析：化脓性颌骨骨髓炎约占各类型颌骨骨髓炎的90%以上。掌握“颌骨骨髓炎”知识点。